胆汁中不含有的物质是
A. 消化酶
B. 胆盐
C. 卵磷脂
D. 胆色素
E. 胆固醇

正确答案：A。消化酶